新斯的明最强的药理作用是
A. 兴奋胃肠道平滑肌
B. 兴奋膀胱平滑肌
C. 缩小瞳孔
D. 兴奋骨骼肌
E. 增加腺体分泌

正确答案：D。兴奋骨骼肌

解析：本题考查新斯的明的药理作用。新斯的明最强的药理作用是兴奋骨骼肌（D对）。新斯的明为季铵类化合物，不易进人中枢神经系统。新斯的明可抑制AChE活性而发挥完全拟胆碱作用，即通过ACh兴奋M、N胆碱受体。能直接激动骨骼肌运动终板上的Nᴍ受体，对骨骼肌兴奋作用较强。兴奋胃肠平滑肌的作用次之，对腺体、眼、心血管及支气管平滑肌作用弱。用于治疗重症肌无力及腹部手术后的肠麻痹。尚可用于阵发性室上性心动过速和对抗竞争性神经肌肉阻滞药过量时的毒性反应。